急性型DIC高凝期患者的治疗原则，除消除病因治疗原发病外，应首先考虑
A. 补充水与电解质
B. 应用抗血小板药物
C. 积极抗纤溶治疗
D. 及早应用肝素
E. 输注全血或血浆

正确答案：D。及早应用肝素

解析：DIC（弥散性血管内凝血）的本质为微血管血栓形成，抗凝治疗是终止病理过程，减轻器官损伤，重建凝血-抗凝平衡的重要措施，故在消除病因治疗原发病的前提下，应首先考虑及早应用肝素（D对）进行抗凝治疗。补充水与电解质（A错）为一般性治疗措施；抗血小板药物（B错）主要作用于血小板，抑制血小板聚集和释放，而DIC是由于多种病因导致凝血因子或血小板被激活，大量促凝物质进入血液，引起血液高凝状态，单用抗血小板药物效果不佳；积极抗纤溶治疗（P627）（C错）一般不使用，仅用于DIC的基础病因及诱发因素已去除或控制，并有明显纤溶亢进或DIC晚期；输注全血或血浆（P627）（E错）属于替代治疗，适用于DIC低凝期，有明显血小板减少或凝血因子减少者。